舌淡胖嫩，苔白滑润者多属
A. 阳虚水泛
B. 湿热内蕴
C. 外感风热
D. 气血两虚
E. 痰瘀阻络

正确答案：A。阳虚水泛

解析：舌淡白湿润，舌体胖嫩，多属阳虚水湿内停（A对）。黄苔而质腻者，主湿热或痰热内蕴，或为食积化腐（B错）。苔薄白而干，多由外感风热或凉燥所致（C错）。气血两虚的舌象可表现为淡白舌、疲软舌、舌体瘦薄而色淡、剥落苔等（D错）。歪斜舌多因肝风内动，夹痰或夹瘀，痰瘀阻滞经络，使一侧舌肌弛缓，伸缩无力，导致伸舌时舌体向此侧偏斜（E错）。